动眼神经不支配
A. 上斜肌
B. 提上睑肌
C. 下斜肌
D. 内直肌
E. 无

正确答案：A。上斜肌

解析：动眼神经支配上直肌、上睑提肌（B对）、下直肌、内直肌（D对）和下斜肌（C对）。上斜肌（A错，为本题正确选项）由滑车神经支配。